年轻恒牙牙髓炎症能够进行活髓保存的生理基础是
A. 牙髓腔大，牙髓组织多
B. 根尖孔较大
C. 牙髓血运丰富
D. 根尖乳头再生能力强
E. 以上均正确

正确答案：E。以上均正确

解析：由于年轻恒牙髓腔大，牙髓组织多，牙髓组织中的血运丰富，使得牙髓具有较强的防御能力和修复能力；其次，年轻恒牙根尖孔较大，根尖部牙髓组织呈乳头状与下方的根尖组织（上皮根鞘）移行，局部血液微循环系统丰富，这也造成了年轻恒牙牙髓对炎症有较强的防御能力。这些都为年轻恒牙活髓保存提供给了生理基础。掌握“年轻恒牙牙髓病及根尖周病诊断及治疗”知识点。